乳婴儿中药用量为成人量的
A. 1/2～2/3
B. 1/6
C. 1/2
D. 1/3
E. 等量

正确答案：D。1/3

解析：小儿中药用量为新生儿用成人量的1/6，乳婴儿为成人量的1/3（D对），幼儿为成人量的1/2，学龄儿童为成人量的2/3或成人量。